容易引起组织缺氧的污染物是
A. SO₂、烟尘
B. O₂、NOₓ
C. NOₓ、碳氢化合物
D. CO、O₃、NOₓ
E. CO、O₃、NO

正确答案：E。CO、O₃、NO

解析：本题考查容易引起组织缺氧的污染物。容易引起组织缺氧的污染物是CO、O₃、NO（E对ABCD错）。CO和NO都是有毒的气体，可以抑制人体的氧合酶，从而阻碍氧气的运输，导致组织缺氧。O₃是一种活性氧，可以损害细胞膜，使细胞失去氧气，从而导致组织缺氧。